颅内压增高的典型表现是
A. 头痛呕吐视神经乳头水肿
B. 昏睡昏迷
C. 瞳孔散大对光反射消失
D. 头晕猝倒
E. 头皮静脉怒张

正确答案：A。头痛呕吐视神经乳头水肿

解析：颅内压增高的典型表现是头痛、呕吐、视神经乳头水肿（颅内压增高“三主征”）（A对）。昏睡、昏迷（B错）以及瞳孔散大，对光反射消失（C错）见于严重的颅内压增高患者。头晕猝倒（D错）多见于椎动脉型颈椎病，较少见于颅内压增高的病人。头皮静脉怒张（E错）、头皮菲薄等为脑积水的常见表现。